土壤的卫生标准是指土壤中有害物质的
A. 背景值
B. 残留值
C. 对照值
D. 环境容量
E. 最高容许浓度

正确答案：E。最高容许浓度

解析：本题考查最高容许浓度。土壤的卫生标准是指土壤中有害物质的最高容许浓度（E对ABCD错）。最高容许浓度系指某一外源化学物可以在环境中存在而不致对人体造成任何损害作用的浓度。